《中国药典》规定，应检查不溶性微粒的注射剂有
A. 用于鞘内注射的溶液型注射液
B. 用于椎管内注射的溶液型注射液
C. 用于静脉注射的溶液型注射液
D. 用于肌内注射的溶液型注射液
E. 用于静脉滴注的溶液型注射液

正确答案：A、B、C、E。用于鞘内注射的溶液型注射液；用于椎管内注射的溶液型注射液；用于静脉注射的溶液型注射液；用于静脉滴注的溶液型注射液

解析：本题考查注射剂的质量检查项目与要求。下列制剂需要进行不溶性微粒检查是用于鞘内注射的溶液型注射液（A对）、用于椎管内注射的溶液型注射液（B对）、用于静脉注射的溶液型注射液（C对）、用于静脉滴注的溶液型注射液（E对）。不溶性微粒：用于静脉注射、静脉滴注、鞘内注射、椎管内注射的溶液型注射液、注射用无菌粉末及注射用浓溶液按《中国药典》规定的检查法检查，应符合规定。